药品是由活性成分和辅料（非活性成分）组成，药用辅料的作用有
A. 赋形
B. 提高药物稳定性
C. 降低药物不良反应
D. 提高药物疗效
E. 增加患者用药的依从性

正确答案：A、B、C、D、E。赋形；提高药物稳定性；降低药物不良反应；提高药物疗效；增加患者用药的依从性

解析：本题考查药用辅料的作用。药用辅料的作用有：（1）赋型（A对）；（2）使制备过程顺利进行；（3）提高药物稳定性（B对）；（4）提高药物疗效（D对）；（5）降低药物毒副作用（C对）；（6）调节药物作用；（7）增加病人用药的顺应性（E对）。